正确的乳房检查方法是
A. 以手掌放于乳房上轻轻按摩
B. 四指并拢，用指腹平放于乳房上轻柔按摩
C. 以食指先触到肿物，并仔细区别与周围组织的关系
D. 以食指首先触摸是否有肿物存在，并注意是否活动
E. 以手托起乳房，用另一手仔细触摸

正确答案：B。四指并拢，用指腹平放于乳房上轻柔按摩

解析：乳房检查正确的触诊方法是四指并拢，用指腹平放于乳房上轻柔触摸（B对）。手掌的敏感度不如指腹（A错）。故以手托起乳房，用另一手仔细触摸是不正确的（E错）。其顺序是先触按整个乳房，然后按照一定次序触摸乳房的4个象限，即内上、外上、外下、内下象限，继而触摸乳晕部分，注意乳头有无溢液或溢血。最后触摸腋窝、锁骨下及锁骨上区域。故以食指先触到肿物（C错）。或以食指首先触摸是否有肿物存在都是不可取的（D错）。